医生在中药处方中应用不同的术语，对饮片炮制、产地、质地、采时、新陈、颜色、气味等有特殊要求加以注明。下列与药名有关的术语中，属于对品质有特殊要求的是
A. 田三七
B. 江枳壳
C. 陈香橼
D. 明天麻
E. 紫丹参

正确答案：D。明天麻

解析：本题考查的是与药名有关的术语。属于对品质有特殊要求的是明天麻（D对）。与药名有关的术语：1.炮制类：采用不同的方法炮制中药，可获得不同的作用和疗效。医师根据医疗需要，提出不同的炮制要求。如酒蒸大黄，能缓和其泻下作用；蜜炙麻黄，能缓和其辛散之性，增强其止咳平喘功效；炒山药，能增强其健脾止泻作用。2.修治类：修治是除去杂质和非药用部分，以洁净药材，保证其符合医疗需要。如远志去心，山茱萸去核，乌梢蛇去头、鳞片等。3.产地类：中药讲究道地药材，医师在药名前常标明产地。如怀山药、田三七（A错）、东阿胶、杭白芍、广藿香、江枳壳（B错）、建泽泻等。4.品质类：药材的品质优劣直接影响到疗效，历代医家都非常重视药材的质量优劣，医师处方对药品质量提出了要求。如明天麻、子黄芩、左牡蛎、左秦艽、金毛狗脊、鹅枳实、马蹄决明、九孔石决明、净山楂等。5.采时、新陈类：药材的质量与采收季节密切相关，有的以新鲜者为佳，有的以陈久者为佳。医师处方对此也有不同要求。如绵茵陈（质嫩）、陈香橼（C错）、陈佛手、陈皮、嫩桂枝、鲜芦根、鲜茅根、霜桑叶等。6.颜色、气味类：药材的颜色和气味也与质量密切相关。如紫丹参（E错）、香白芷、苦杏仁等。